手厥阴心包经的郄穴是
A. 地机
B. 养老
C. 中都
D. 郄门
E. 梁丘

正确答案：D。郄门

解析：手厥阴心包经的郄穴是郄门（D对）。地机（A错）是足少阴脾经的郄穴；养老（B错）是手太阳小肠经的郄穴；中都（C错）是足厥阴肝经的郄穴；梁丘（E错）是足阳明胃经的郄穴。